下列疾病中，最常表现为呼气性呼吸困难的疾病是
A. 气管异物
B. 急性喉炎
C. 气胸
D. 支气管哮喘
E. 心力衰竭

正确答案：D。支气管哮喘

解析：针对呼吸系统疾病，在分析呼吸困难时应注意是吸气性还是呼气性呼吸困难，前者见于肿瘤或异物（A错）堵塞引起的大气道狭窄、喉头水肿、急性喉炎（B错）等；后者主要见于支气管哮喘（D对）、慢性支气管炎、肺气肿等。大量气胸（C错）、大量胸腔积液及胸廓限制性疾病则表现为混合型呼吸困难。心力衰竭（E错）导致的心源性哮喘是由于急性肺水肿引起的气喘，最突出的临床表现为阵发性夜间呼吸困难，典型发作多发生在夜间熟睡1～2小时后，患者因气闷、气急而突然惊醒，被迫立即坐起，伴以阵咳、咳粉红色泡沫状痰。